属于非磺酰脲类胰岛素分泌促进剂的降血糖药物是
A. 那格列奈
B. 盐酸二甲双胍
C. 阿卡波糖
D. 格列吡嗪
E. 盐酸吡格列酮

正确答案：A。那格列奈

解析：本题考查非磺酰脲类胰岛素分泌促进剂类降糖药。那格列奈（A对）是D-苯丙氨酸衍生物，属于非磺酰脲类促胰岛素分泌剂。二甲双胍（B错）、吡格列酮（E错）均为胰岛素增敏剂。阿卡波糖（C错）为α-葡萄糖苷酶抑制剂。格列吡嗪（D错）为磺胺脲类胰岛素分泌促进剂。